使脑脊液渗入静脉的是
A. 下矢状窦
B. 蛛网膜粒
C. 下髓帆
D. 软脑膜
E. 硬脑膜

正确答案：B。蛛网膜粒

解析：脑的被膜由外向内依次为硬脑膜、脑蛛网膜和软脑膜。脑蛛网膜在上矢状窦处形成许多绒毛状突起，突入上矢状窦内，称蛛网膜粒。脑脊液经这些蛛网膜粒（B对）渗入硬脑膜窦内，回流入静脉。下矢状窦为硬脑膜窦，脑脊液回流时经过上矢状窦但不经过下矢状窦（A错）。下髓帆（C错）为第四脑室壁的组成结构，与脑脊液回流无关。脑脊液回流进入蛛网膜粒，蛛网膜粒由脑蛛网膜而不是由软脑膜（D错）、硬脑膜（E错）形成。